患者女性，33岁，劳累后心悸气促加重3年。不能平卧伴咯血。检查：二尖瓣面容，第一心音亢进，心尖部可闻及隆隆样舒张期杂音，P₂＞A₂，心率规则。其治疗措施是
A. 速尿静脉注射
B. 止血剂
C. 吸氧
D. 西地兰静脉注射
E. 镇咳剂

正确答案：A。速尿静脉注射

解析：劳累后心悸气促3年，不能平卧伴咯血检查（左心衰竭表现），二尖瓣面容（主要表现为风湿性心脏病和二尖瓣狭窄患者的面部，面颊部紫红、口唇紫绀，合并颜面部水肿），第一心音亢进，心尖部可闻及隆隆样舒张期杂音（提示患者二尖瓣狭窄），P₂＞A₂（肺循环阻力增高或者血流增高，如肺心病、肺动脉高压、左心衰竭），心率规则。利尿剂应用的目的是控制心力衰竭的液体潴留（A对）。止血剂通过改善初始止血过程，刺激纤维蛋白形成或者抑止纤维蛋白溶解来改善止血。主要方法是输注血小板和凝血因子（B错）。吸氧用于纠正缺氧，提高动脉血氧分压和氧饱和度的水平，促进代谢，是辅助治疗多种疾病的重要方法之一。如呼吸衰竭，慢性气管炎，脑血管病，冠心病（C错）。西地兰用于急性和慢性心力衰竭、心房颤动和阵发性室上性心动过速，肺心病导致心力衰竭常有低氧血症，应慎用（D错）。左心衰竭引起的咳嗽，常用镇咳药物有可待因，患者无咳嗽症状（E错）。